男性，45岁，间断上腹痛3年，加重2个月，胃镜检查发现胃角切迹溃疡，幽门螺杆菌阳性。其治疗方案首选
A. H₂受体拮抗剂治疗
B. 粘膜保护剂治疗，6周复查胃镜
C. 质子泵抑制剂+粘膜保护剂治疗，4周复查胃镜
D. 抗幽门螺杆菌治疗+质子泵抑制剂治疗，6周复查胃镜
E. 抗幽门螺杆菌治疗，2周复查胃镜

正确答案：D。抗幽门螺杆菌治疗+质子泵抑制剂治疗，6周复查胃镜

解析：中年男性患者，间断上腹痛3年病史，胃镜检查可见胃角切迹溃疡，幽门螺杆菌阳性，可诊断为Hp相关胃炎，其治疗方案有：1种PPI+2种抗生素或1种铋剂+2种抗生素，即抗幽门螺杆菌治疗+质子泵抑制剂，疗程通常为4～6周，然后复查胃镜（D对）。